用薄层色谱检识中药化学成分时，在紫外光下可显蓝色荧光的化合物类型是
A. 二萜
B. 三萜
C. 多糖
D. 香豆素
E. 胆汁酸

正确答案：D。香豆素

解析：本题考查的是香豆素的荧光性质。用薄层色谱检识中药化学成分时，在紫外光下可显蓝色荧光的化合物类型是香豆素（D对）。香豆素类在可见光下为无色或浅黄色结晶。香豆素母体本身无荧光，而羟基香豆素在紫外光下多显出蓝色荧光，在碱溶液中荧光更加显著。